患者，女，75岁，既往有2型糖尿病史18年，有青霉素过敏史，因车祸导致左下肢开放性骨折。术后发生骨髓炎，给予克林霉素治疗10余天，临床应关注的典型不良反应是
A. 肌肉震颤
B. 红人综合征
C. 抗生素相关性腹泻
D. 急性溶血性贫血
E. 血小板减少

正确答案：C。抗生素相关性腹泻

解析：本题考查克林霉素的不良反应。临床应关注的典型不良反应是抗生素相关性腹泻（C对）。克林霉素属于林可霉素类抗菌药物，克林霉素的不良反应少见过敏反应、皮疹、瘙痒等，偶见荨麻疹、血管神经性水肿和血清病反应、肠道菌群失调和抗生素相关性腹泻、肝脏氨基转移酶ALT及AST升高等，罕见表皮脱落、大疱型表皮坏死松解症、多形性红斑和Stevens-Johnson综合征。肌肉震颤（A错）主要由于黑质和黑质纹状体通路病变而引起，某些化学物质中毒也可以出现肌肉震颤的毒作用表现。红人综合征（B错）多发生于万古霉素滴注过程中，与输注万古霉素的剂量及速度有关。溶血性贫血（D错）是由于红细胞破坏速率增加（寿命缩短），超过骨髓造血的代偿能力而发生的贫血。血小板减少（E错）见于多种血液性疾病、风湿免疫病、放化疗损伤及药物相关性血小板减少。